皮肤损害为松弛的大疱，破后有黄褐色鳞屑痂，边缘翘起似剥脱性皮炎。口腔损害少见，此为天疱疮的哪种类型
A. 寻常型天疱疮
B. 落叶型天疱疮
C. 颗粒型天疱疮
D. 红斑型天疱疮
E. 增殖型天疱疮

正确答案：B。落叶型天疱疮

解析：落叶性天疱疮：皮肤损害为松弛的大疱，疱破后有黄褐色鳞屑痂，边缘翘起呈叶状，类似剥脱性皮炎。口腔损害少见，或微有红肿，若有糜烂常不严重。掌握“天疱疮”知识点。